睾丸间质细胞的主要生理功能是
A. 营养和支持生殖细胞
B. 产生精子
C. 分泌雄激素
D. 促进精子成熟
E. 起血睾屏障作用

正确答案：C。分泌雄激素